下列哪项叙述是不正确的
A. 关节翼肌窝为翼外肌附着处
B. 下颌小舌为翼下颌韧带附着处
C. 翼肌粗隆为翼内肌附着处
D. 茎突下颌韧带附着于下颌角处
E. 上颏棘为颏舌肌的附着处

正确答案：B。下颌小舌为翼下颌韧带附着处

解析：下颌小舌为蝶下颌韧带附着处。翼下颌皱襞为延伸于上颌结节后内方与磨牙后垫后方之间的粘膜皱襞，其深面有翼下颌韧带。掌握“下颌骨及腭骨解剖特点”知识点。